维生素A制成微囊的目的是
A. 降低介电常数使注射液稳定
B. 防止药物水解
C. 防止药物氧化
D. 降低离子强度使药物稳定
E. 防止药物聚合

正确答案：C。防止药物氧化

解析：本题考查药物制剂稳定化方法。维生素A制成微囊是为了防止氧化（C对）。采用微囊化和包合技术，可防止药物因受环境中的氧气、湿度、水分、光线的影响而降解，从而增加其稳定性。如维生素A制成微囊后稳定性提高。苯巴比妥钠注射液中，药物离子与攻击的离子的电荷相同，即OH⁻催化水解苯巴比妥阴离子，故可以用介电常数低的溶剂降低药物分解速度，使注射液稳定（A错）。维生素A制成微囊并不是以防止水解（B错）、防止药物聚合（E错）为目的。维生素A制成微囊并未降低离子强度（D错）。